描述性研究的用途，以下哪个是错误的
A. 描述疾病和某种特征的分布
B. 提出进一步病因研究的线索
C. 检验和验证病因假说
D. 提出和初步检验病因假说
E. 进行社区诊断

正确答案：C。检验和验证病因假说

解析：本题考查描述性研究的用途。描述性研究可用来描述疾病和某种特征的分布（A对）；提出进一步病因研究的线索（B对）；提出和初步检验病因假说（D对）；进行社区诊断（E对）等。检验和验证病因假说（C错，为本题正确答案）属于分析流行病学和实验流行病学的范畴。